成年女性尿中可出现的细胞是
A. 小圆上皮细胞
B. 大圆上皮细胞
C. 扁平上皮细胞
D. 尾形上皮细胞
E. 脂肪颗粒细胞

正确答案：C。扁平上皮细胞

解析：扁平上皮细胞又称复层鳞状上皮细胞，来自女性阴道及尿道，成人女性尿中常见，临床意义不大。若尿中大量出现或片状脱落且伴有白细胞、脓细胞，见于尿道炎（C对）。小圆上皮细胞主要来自肾小管上皮，尿中出现此类细胞表示肾小管有病变，常见于急性肾小球肾炎，成堆出现表示有肾小管坏死，也见于肾移植术后急性排斥反应（A错）。大圆上皮细胞来自膀胱上皮表层、尿道和阴道上皮中层，偶见于正常人尿内，大量出现见于膀胱炎（B错）。尾形上皮细胞多来自肾盂，又称肾盂上皮细胞，有时来自输尿管。此类细胞在正常尿中不易发现，肾盂肾炎、输尿管炎时可见成片脱落（D错）。在管型蛋白基质中含有多量脂肪滴或者有脂肪变性的肾小管上皮细胞，超过管型的1/3。常见于肾病综合征、慢性肾炎急性发作、中毒性肾病等（E错）。